健康教育和健康促进的伦理要求不包括
A. 履行义务，参加充分利用一切机会和场合积极主动的开展健康教育
B. 积极参加有利于健康促进的公共政策的制定、支持性环境的创建和卫生保健体系的建立
C. 深入农村、社区，将健康教育与健康促进工作渗透在初级卫生保健工作中
D. 不断完善自我，以科学态度和群众喜闻乐见的形式开展健康教育和健康促进工作
E. 依法开展卫生监督和管理，从源头控制职业性损害，对劳动者的安全和健康负责

正确答案：E。依法开展卫生监督和管理，从源头控制职业性损害，对劳动者的安全和健康负责